热熨法可用于治疗的病证是
A. 外阴肿痛
B. 痛经
C. 阴道炎
D. 宫颈癌
E. 外阴炎

正确答案：B。痛经

解析：热熨法适用于痛经（B对），慢性盆盆腔炎，妇科术后腹痛，产后小便不通等。外阴肿痛（A错）常用敷贴法。冲洗法适用于阴道炎（C错）。坐浴或熏洗法适用于外阴炎（E错）。宫颈癌适用于手术治疗（D错）。